归来穴归属的经脉是
A. 手太阴肺经
B. 手阳明大肠经
C. 足阳明胃经
D. 足太阴脾经
E. 手少阴心经

正确答案：C。足阳明胃经

解析：归来穴属足阳明胃经穴（C对），在下腹部，脐中下4寸，前正中线旁开2寸。主治小腹痛、疝气；月经不调、带下、阴挺等妇科疾患，宜直刺1-1.5寸。